溶血性黄疽时下列哪一项不出现
A. 非结合胆红素增加
B. 尿胆红素阳性
C. 血清总胆红素增加
D. 尿胆原阳性
E. 粪便颜色加深

正确答案：B。尿胆红素阳性

解析：一般能引起溶血的疾病都能引发溶血性黄疸，溶血性黄疸常表现为血中非结合胆红素增加（A对）。因为未结合胆红素不溶于水，结合胆红素又可正常排泄，故尿胆红素阴性（B错，为本题正确答案）。溶血性黄疸血清总胆红素增加（C的）。由于结合胆红素排入肠道增多，所以尿胆原增多，呈阳性反应（D对）。同时粪胆原增多，大便颜色加深（E对）。